下列不是异烟肼不良反应的是
A. 损伤肝细胞
B. 各种皮疹
C. 发热
D. 胃肠道反应
E. 中央神经炎

正确答案：E。中央神经炎

解析：异烟肼的不良反应为：①神经系统：常见反应为周围神经炎，表现为手脚麻木、肌肉震颤和步态不稳等。大剂量可出现头痛、头晕、兴奋和视神经炎，严重时可导致中毒性脑病和精神病。使用异烟肼时应注意及时补充维生素B6预防不良反应的产生。癫痫及精神病患者慎用。②肝脏毒性：异烟肼可损伤肝细胞，使转氨酶升高，少数患者可出现黄疸，严重时亦可出现肝小叶坏死，甚至死亡。③其他：可发生各种皮疹、发热、胃肠道反应、粒细胞减少、血小板减少和溶血性贫血，用药期间亦可能产生脉管炎及关节炎综合征。掌握“异烟肼、利福平及乙胺丁醇”知识点。